对由甲氨蝶呤所引发的贫血者，宜合并应用
A. 叶酸+维生素B₁₂
B. 富马酸亚铁
C. 维生素K₁
D. 甲磺酸去铁胺
E. 亚叶酸钙

正确答案：E。亚叶酸钙

解析：本题考查治疗巨幼红细胞性贫血的药物。对由甲氨蝶呤所引发的贫血者，宜合并应用亚叶酸钙（E对）。叶酸+维生素B₁₂（A错）用于营养不良、婴儿期所致的恶性贫血。富马酸亚铁（B错）用于缺铁性贫血。维生素K₁（C错）用于各种维生素K缺乏引起的出血性疾病。甲磺酸去铁胺（D错）为铁中毒的解毒剂。